某男，25岁。1周前患风湿热头痛，近日又患目赤肿痛羞明。治当疏散风热，明目退翳，宜选用的药是
A. 熊胆
B. 秦皮
C. 夏枯草
D. 谷精草
E. 青葙子

正确答案：D。谷精草

解析：本题考查的是谷精草的功效。1周前患风湿热头痛，近日又患目赤肿痛羞明。治当疏散风热，明目退翳，宜选用的药是谷精草（D对）。谷精草：【功效】疏散风热，明目退翳。秦皮（B错）：【功效】清热解毒，燥湿止带，清肝明目。夏枯草（C错）：【功效】清肝明日，散结消肿。青葙子（E错）：【功效】清肝泻火，明目退翳。熊胆（A错）的应用，2022年考试指南未明确说明。熊胆：【功效】清热解毒，明目，止痉。